肺内功能性分流是指
A. 部分肺泡通气不足
B. 部分肺泡血流不足
C. 部分肺泡通气不足而血流正常
D. 部分肺泡血流不足而通气正常
E. 肺动一静脉吻合支开放

正确答案：C。部分肺泡通气不足而血流正常

解析：肺内功能性分流是指部分肺泡通气不足而血流正常（C对）。